妇产科疾病中医常见病因不包括
A. 六淫邪气
B. 七情内伤
C. 金刃所伤
D. 生活所伤
E. 体质因素

正确答案：C。金刃所伤

解析：导致妇产科疾病的病因主要有：1.淫邪致病（A对），淫邪因素主要指风、寒、暑、湿、燥、火六种致病邪气，六淫皆能导致妇产科疾病，但妇女“以血为本”，寒、热、湿邪更易与血相结而引发妇产科疾病。2.情志因素（B对），指喜、怒、忧、思、悲、恐、惊七种情志变化，正常情况下是人的心理对外界环境和情感刺激的不同反应，情志过激则成为致病因素，主要引起气分病变，继而累及血分，导致妇女气血、脏腑、冲任功能失调而发生妇产科病证。3.生活失调（D对），可以影响脏腑气血的正常功能，引起妇产科疾病。4.体质因素（E对），人体由于先天禀赋不同，后天条件的差异，可以形成不同类型的体质（C错，为本题正确答案）。